脑血栓形成急性期有效治疗方法是
A. 3小时内用rt-PA
B. 12小时内用rt-PA
C. 罂粟碱
D. 尼莫地平
E. 低分子量肝素

正确答案：A。3小时内用rt-PA

解析：脑血栓形成急性期在4.5小时内为临床溶栓治疗的适应症。常在4.5小时内应用rt-PA（A对B错）或UK作溶栓治疗。发病24小时以内为改善缺血脑组织的灌注，维持较高的血压是非常重要的，因此一般不用罂粟碱（C错）和尼莫地平（D错）等降压药（P181）。脑血栓形成急性期一般不推荐使用低分子量肝素（E错）等抗凝治疗（P183）。